男，45岁。肝功能异常15年，门腔静脉分流术后2年，性格改变、睡眠倒错3天。以下处理措施正确的是
A. 输血
B. 口服乳果糖
C. 碱性肥皂水灌肠
D. 静脉滴注抗生素
E. 口服巴比妥

正确答案：B。口服乳果糖

解析：中年男子，肝功能异常15年（长期肝功能异常是引起肝性脑病的常见原因），门腔静脉分流术后（门腔静脉分流术后是肝性脑病的常见诱因）。性格改变、睡眠倒错，据此可诊断为肝性脑病1期（前驱期）。口服乳果糖（B对）后，乳果糖在小肠不被分解，到达结肠后可被分解为乳酸、乙酸，从而降低肠道pH。肠道酸化后，肠道细菌产氨减少，此外，酸性的肠道环境可减少氨的吸收，促使血液中的氨渗入肠道排出体外，从而治疗各期肝性脑病。输入库存血，可加重氮质血症，增加血氨来源，加重肝性脑病病情，故输血（A错）不宜用于治疗肝性脑病，但可输入新鲜血浆以补充凝血因子，输入白蛋白以改善低蛋白血症。碱性肥皂水灌肠（C错）可增加肠道对氨的吸收，不宜用于治疗肝性脑病。口服抗生素可抑制肠道产尿素酶的细菌，减少氨的生成，但静脉滴注抗生素（D错）则无此作用。口服巴比妥（E错）等镇静剂，可诱发或加重肝性脑病。